一位患者表现交叉性舌下神经瘫痪。右侧舌萎缩，伸舌时偏向右侧。此外，病人出现左半身上运动神经元瘫痪。该病人，左半身瘫痪是由于病变累及
A. 锥体交叉以上的左侧锥体束
B. 锥体交叉以上的右侧锥体束
C. 右侧内侧丘系
D. 右侧外侧丘系
E. 右侧皮质延髓束

正确答案：B。锥体交叉以上的右侧锥体束

解析：锥体束经椎体交叉至对侧后，支配身体对侧的随意运动。因锥体束的功能受到破坏，上运动神经元损伤后会表现为：随意运动障碍；肌张力增高，故称痉挛性瘫痪（硬瘫），但早期肌萎缩不明显；深反射亢进（因失去高级控制），浅反射（如腹壁反射、提睾反射等）减弱或消失（因锥体束的完整性被破坏）；出现病理反射。所以该病人出现左半身瘫痪的原因是病变累及锥体交叉以上的右侧锥体束（B对）。